既可用治外感风寒，又可用于外感风热的药物是
A. 麻黄
B. 防风
C. 桂枝
D. 紫苏
E. 羌活

正确答案：B。防风

解析：防风以辛散祛风解表为主，虽不长于散寒，但又能胜湿止痛，且甘缓微温不峻烈，故外感风寒、风湿、风热表证均可配伍使用（B对）。麻黄（A错）善于宣肺气、开腠理、透毛窍而发汗解表，发汗力强，为发汗解表之要药。桂枝（C错）善于宣阳气于卫分，畅营血于肌表，对于外感风寒，无论表实无汗、表虚有汗及阳虚受寒者均可使用。紫苏（D错）发汗解表散寒之力较为缓和，轻证单用，重证与其他发散风寒药合用。羌活（E错）有较强的解表散寒，祛风胜湿止痛之功，外感风寒夹湿，肌表无汗，头痛项强，肢体酸痛较重者尤为适宜。